下列违反药品广告申请和发布规定的违法行为，其法律责任3年内不受理该品种广告审批申请的是
A. 甲企业篡改经批准的琥乙红霉素片广告内容，进行虚假宣传的
B. 丙企业提供提供虚假材料，申请刺五加广告审批，并取得广告批准文，事后被药品广告审查机关发现的
C. 乙企业异地发布已被注销药品广告批准文号的氟哌酸胶囊的广告
D. 丁企业提供虚假材料申请左氧氟沙星注射液广告审批，在受理审查中被药品广告审查机关发现的

正确答案：B。丙企业提供提供虚假材料，申请刺五加广告审批，并取得广告批准文，事后被药品广告审查机关发现的

解析：本题考查以违反药品广告管理的处罚。下列违反药品广告申请和发布规定的违法行为，其法律责任3年内不受理该品种广告审批申请的是丙企业提供提供虚假材料，申请刺五加广告审批，并取得广告批准文，事后被药品广告审查机关发现的（B对）。以不当方式获得广告批准文件的处罚：隐瞒真实情况或者提供虚假材料申请药品、医疗器械、保健食品和特殊医学用途配方食品广告审查的（D错）；或者以欺骗、贿赂等不正当手段取得药品、医疗器械、保健食品和特殊医学用途配方食品广告批准文号的，按照《广告法》第六十五条处罚，广告审查机关不予受理或者不予批准，予以警告，一年内不受理该申请人的广告审查申请；以欺骗、贿赂等不正当手段取得广告审查批准的，广告审查机关予以撤销，处十万元以上二十万元以下的罚款，三年内不受理该申请人的广告审查申请。无有效批准文件发布的广告的处罚：未经审查发布药品、医疗器械、保健食品和特殊医学用途配方食品广告；或者广告批准文号已超过有效期，仍继续发布药品广告（C错）；以及未按照审查通过的内容发布药品广告（A错），按照《广告法》第五十八条处罚，由市场监督管理部门责令停止发布广告，责令广告主在相应范围内消除影响，处广告费用一倍以上三倍以下的罚款，广告费用无法计算或者明显偏低的，处十万元以上二十万元以下的罚款；情节严重的，处广告费用三倍以上五倍以下的罚款，广告费用无法计算或者明显偏低的，处二十万元以上一百万元以下的罚款，可以吊销营业执照，并由广告审查机关撤销广告审查批准文件、一年内不受理其广告审查申请。